胃脘胀满疼痛，嗳气酸腐，不欲食，证属
A. 胃寒
B. 气滞
C. 食积
D. 胃气虚
E. 血瘀

正确答案：C。食积